噪声聋在病变性质上属哪种类型
A. 神经性耳聋
B. 感音性耳聋
C. 传导性耳聋
D. 混合性耳聋
E. 过敏性耳聋

正确答案：B。感音性耳聋

解析：本题考查噪声聋的病变性质。职业性噪声聋是指劳动者在工作过程中，由于长期接触噪声而发生的一种渐进性的感音性听觉损伤。职业性噪声聋的诊断需要有明确的噪声接触职业史，有自觉听力损失或耳鸣等其他症状，听力曲线为感音性耳聋（B对ACDE错），结合动态职业健康检查资料和现场卫生学调查，排除其他原因所致听力损失，可进行诊断。